至宝丹的功用
A. 开窍定惊，清热化痰
B. 清热解毒，开窍醒神
C. 清热解毒，开窍安神
D. 化浊开窍，清热解毒
E. 清热开窍，息风止痉

正确答案：D。化浊开窍，清热解毒

解析：该题考查至宝丹的功用。选项均为凉开的功用，开窍定惊，清热化痰是小儿回春丹的功用（A错）。清热解毒，开窍醒神为安宫牛黄丸的功用（B错）。清热解毒，开窍安神为牛黄清心丸的功用（C错）。化浊开窍，清热解毒为至宝丹的功用（D对）。清热开窍，息风止痉为紫雪丹的功用（E错）。